营养不良时，患者血浆蛋白含量减少，使用蛋白结合律高的药物，可出现
A. 作用增强
B. 作用减弱
C. t1/2延长，作用增强
D. t1/2缩短，作用减弱
E. 游离药物浓度下降

正确答案：A。作用增强

解析：本题考查影响药物分布的因素。营养不良的患者血浆蛋白含量下降，血中游离药物浓度增加，使用蛋白结合率高的药物，可引起药物效应增加（A对BE错）；药物消除半衰期是血浆浓度下降到一半所需要的时间，t1/2为一个常数，不受药物初始浓度和给药剂量的影响，此题无法推断半衰期的变化（CD错）。